患者输血5分钟后即出现寒战，高热，头痛，腰背部剧痛，心前区压迫感。检查：血压78/60mmHg（10.4/8kPa），血浆呈粉红色。应首先考虑的是
A. 发热反应
B. 过敏反应
C. 溶血反应
D. 细菌污染反应
E. 以上均非

正确答案：C。溶血反应

解析：溶血反应的一般表现为头痛，胸痛，心前区压迫感，全身不适，腰背酸痛，寒战，高热，恶心，呕吐，脸色苍白，烦躁不安，呼吸急迫，脉搏细速，甚至休克。根据症状应首先考虑的是溶血反应（C对）。发热反应（A错）主要症状是寒战、发热，可是有恶心、呕吐，皮肤潮热。过敏反应（B错）常以荨麻疹，颜面部血管神经性水肿为特征，少数可表现为下肢腓肠肌疼痛，腹泻，支气管痉挛，严重者出现咽部水肿，甚至过敏性休克。细菌污染反应（D错）甚至可危及生命，应立即给予抗感染、抗休克及预防DIC等治疗措施，均不是首先应考虑的诊断。